环境有害物质是指环境中对人体可产生不良作用的
A. 物理因子、化学因子
B. 化学因子、生物因子
C. 生物因子、物理因子
D. 物理因子、化学因子、生物因子
E. 物理因子、化学因子、微生物因子

正确答案：D。物理因子、化学因子、生物因子

解析：本题考查环境有害物质。环境有害物质是指环境中对人体可产生不良作用的物理因子、化学因子、生物因子（D对ABCE错）。物理因子一般是指高能量的射线，如X射线、γ射线和紫外线等，它们可以破坏人体细胞中的DNA，从而引起癌症等疾病。化学因子是指空气中的有毒气体和溶液，如大气中的二氧化硫、氮氧化物等，它们可以造成人体肺部和呼吸道疾病，如哮喘、慢性支气管炎等。生物因子是指病原体、昆虫、藻类、蛋白质等对人体可能造成不良影响的物质，它们可以引起细菌性传染病、病毒性传染病等疾病。